片剂包衣的种类有
A. 糖衣
B. 薄膜衣
C. 肠溶衣
D. 控释衣
E. 缓释衣

正确答案：A、B、C、D、E。糖衣；薄膜衣；肠溶衣；控释衣；缓释衣

解析：本题考查片剂的包衣。片剂包衣的种类有糖衣（A错）、薄膜衣（B错）、肠溶衣（C错）、控释衣（D错）、缓释衣（E错）。包衣片的种类有糖衣片、（半）薄膜衣片、肠溶衣片、结肠定位肠溶衣片以及缓释衣片、控释衣片。